关于彗星试验，下列说法错误的是
A. 以DNA损伤为检测终点
B. 原理是大片段DNA比断裂的DNA片段迁移的快，电泳后出现彗星状
C. 试验过程中需要制备单细胞悬液
D. 该方法敏感性高，要求的细胞数少

正确答案：B。原理是大片段DNA比断裂的DNA片段迁移的快，电泳后出现彗星状

解析：本题考查彗星试验。彗星实验也称单细胞凝胶电泳试验，是一种有效评估DNA损伤的方法。其原理是器官或组织经处理（如辐射、重金属等）后，细胞中的DNA发生单链或双链断裂，经细胞及其核膜裂解后，DNA解旋，在电场作用下，DNA 断片迁移出细胞核，形成彗星状的电泳图谱（B错，为本题正确答案）。彗星试验以DNA损伤为检测终点（A对），试验过程中需要制备单细胞悬液（C对）。该方法敏感性高，要求的细胞数少（D对）。